右淋巴导管收集淋巴的范围是
A. 右半身
B. 右侧上半身
C. 右侧下半身
D. 下半身及右上半身
E. 除左侧头部以外的其他部分

正确答案：B。右侧上半身

解析：右侧上半身（B对）即右上肢、右胸部和右头颈部的淋巴为右淋巴导管所收集。